注射丙种球蛋白属于
A. 自然自动疫苗
B. 自然被动疫苗
C. 人工自动疫苗
D. 人工被动疫苗
E. 人工自动被动疫苗

正确答案：D。人工被动疫苗

解析：本题考查人工被动免疫。人工被动免疫是将含有特异性抗体的血清或制剂接种人体，使机体被动地获得特异性免疫力而受到保护。注射丙种球蛋白属于人工被动疫苗（D对ABCE错）。